赭石的条痕色是
A. 绿黑色
B. 樱红色
C. 白色
D. 黄棕色
E. 紫色

正确答案：B。樱红色

解析：本题考查的是矿物类中药的条痕色。赭石的条痕色是樱红色（B对）。条痕及条痕色：矿物在白色毛瓷板上划过后所留下的粉末痕迹称为条痕，粉末的颜色称为条痕色。条痕色比矿物表面的颜色更为固定，更能反映矿物的本色，因而更具鉴定意义。有的矿物表面的颜色与粉末颜色相同，如朱砂，也有的是不相同的，如自然铜，表面为亮淡黄色或棕褐色，而粉末为绿黑色（A错）或棕褐色。矿物均有固定的条痕色，樱红色或红棕色的如赭石，浅橘红色的如雄黄，淡黄色的如硫黄，黑色的如磁石，白色（C错）的如芒硝、紫石英、硝石，无色的如胆矾。条痕色为黄棕色（D错）或紫色（E错）的中药，2022年考试指南未明确说明。